诊断维生素D缺乏性佝偻病的金标准是
A. 多汗、夜惊、烦躁等神经精神症状
B. 血生化与骨骼X线的检查
C. 患儿年龄、季节、病史
D. 根据有日光照射不足等病因
E. 早期佝偻病病儿骨骼改变

正确答案：B。血生化与骨骼X线的检查

解析：根据有日光照射不足及维生素D缺乏的病史，佝偻病的症状和体征，结合血生化改变和骨骼X线改变可作出正确诊断。但应注意早期佝偻病病儿骨骼改变不明显，多汗、夜惊、烦躁等神经精神症状又无特异性，需结合患儿年龄、季节、病史作出综合判断。血清25（0H）D3（正常值10～60μg/L）和1，25（0H）2D3（正常值0.03～0.06μg/L）水平在佝偻病初期就已明显降低，为可靠的早期诊断指标，但很多单位不能检测。血生化与骨骼X线的检查为诊断的“金标准”。掌握“维生素D缺乏性佝偻病”知识点。